腹股沟疝修补术后，切口愈合佳，切口分类与愈合为
A. Ⅰ甲
B. Ⅱ甲
C. Ⅱ乙
D. Ⅱ丙
E. Ⅲ甲

正确答案：A。Ⅰ甲

解析：初期完全缝合的切口可分为三类：①清洁切口（Ⅰ类切口），此指手术缝合的无菌切口，如甲状腺大部切除术、疝修补术等。②可能污染切口（Ⅱ类切口），指手术时可能带有污染的缝合切口，如胃大部切除术、伤后6小时内经清创缝合的伤口、新缝合的切口再度裂开及会阴部的手术切口等。③污染切口（Ⅲ类切口）。指邻近感染区或直接暴露在污染或感染物中的切口，如胃穿孔修补术、穿孔阑尾的切除术、绞窄性肠梗阻的手术切口等。切口愈合也分为三级：①甲级愈合，用"甲"字表示，指愈合优良，无不良反应。②乙级愈合，用"乙"字表示，指愈合处有炎症反应，如红肿、血肿、硬结和积液等，但未化脓。③丙级愈合，用"丙"字表示，指切口化脓，须做切开引流等处理后才能愈合。故腹股沟疝修补术后切口愈合佳，切口分类为Ⅰ甲（A对）。